IgA肾病发展过程中加重肾损害最重要的因素是
A. 反复发作肉眼血尿
B. 水肿
C. 高脂血症
D. 高血压
E. 血清IgA水平升高

正确答案：D。高血压

解析：IgA肾病患者最常见临床表现为肉眼血尿，肉眼血尿发作后，尿红细胞可消失，也可转为镜下血尿；少数患者反复发作肉眼血尿（A错）。IgA肾病患者可无水肿（B错）、高脂血症（C错）等症状。血清IgA水平升高（E错）是IgA肾病患者的特征表现与发展过程中加重肾损害关系不大。